佝偻病性手足搐搦症
A. 血清钙正常，血清磷明显降低
B. 血清钙磷均降低
C. 血清钙磷正常
D. 血清钙磷低
E. 血清钙磷乘积为30～40

正确答案：D。血清钙磷低

解析：本题考查维生素D缺乏性手足搐搦症的相关内容。维生素D缺乏性手足搐搦症也称低钙性惊厥多见于＜6月龄小婴儿，由于缺乏维生素D导致血清钙磷低（D对ABCE错），而甲状旁腺代偿功能不足时，使血中钙离子浓度降低，当总血钙低于1.75～1.8mmol/L（7～7.5mg/dl），或离子钙低于1.0mmol/L（4mg/dl）时可引起神经肌肉兴奋性增高，出现全身惊厥、手足肌肉抽搐或喉痉挛等。